对生物利用度概念错误的叙述是
A. 可作为确定给药间隔时间的依据
B. 可间接判断药物的临床疗效
C. 是指药物制剂被机体利用的程度和速度
D. 可评价药物制剂的质量
E. 能反映机体对药物吸收的程度

正确答案：A。可作为确定给药间隔时间的依据